治疗肩周疼痛，以肩后部为重，疼痛拒按，除肩部穴外，还应选取的是
A. 手太阳小肠经穴
B. 手阳明大肠经穴
C. 手少阳三焦经穴
D. 足少阳胆经穴
E. 足太阳膀胱经穴

正确答案：A。手太阳小肠经穴

解析：肩痹以肩后侧疼痛为主，肩内收时疼痛加剧，为手太阳经证，治疗应加以手太阳小肠经穴（A对）。肩前区疼痛为主，后伸疼痛加剧，为手阳明经证（B错）。以肩外侧疼痛为主，外展疼痛加剧，为手少阳经证（C错）。足少阳胆经腧穴主治侧头、目、耳、咽喉病，神志病，热病及经脉循行部位的其他病证（D错）。足太阳膀胱经穴主治脏腑病证、神志病、头面五官病、经脉循行部位的其他病证，项、背、腰、下肢病证等（E错）。